风心病并发心律失常最多见的是
A. 室性期前收缩(早搏）
B. 窦性心动过速
C. 房颤
D. 房性心动过速
E. 心房扑动

正确答案：C。房颤

解析：风湿性炎症导致的瓣膜损害称为风湿性心脏病，简称风心病。风心病患者并发心率失常，最常见的为心房颤动（C对），尤其是左心房显著扩大的二尖瓣狭窄患者最常见。在房颤发生前，多先有房性期前收缩、心房扑动或阵发性房颤，以后才转为持续性房颤。